患者，女性，65岁，因阵发性胸闷8年，持续胸痛8小时收入院。入院时血压为150/90mmHg，诊断急性前壁心肌梗死。上述患者出现频发室性早搏，伴短阵室性心动过速，此时最恰当的处理应是
A. 静推西地兰
B. 口服美西律
C. 静脉注射利多卡因
D. 口服普鲁卡因胺
E. 口服妥卡尼

正确答案：C。静脉注射利多卡因

解析：患者老年女性，急性前壁心肌梗死诊断明确，患者出现频发室性早搏，伴短阵室性心动过速，此时最恰当的处理应是静脉注射利多卡因（C对）。西地兰（P172）（A错）为洋地黄制剂，最适用于伴有快速心房颤动/心房扑动的收缩性心力衰竭，对室性心动过速效果不佳。美西律（九版药理学P197）（B错）和妥卡尼（E错）都属于ⅠB类抗心律失常药，其中妥卡尼为利多卡因的衍生物，两者均可用于心肌梗死后室性心律失常，但并非首选用药。普鲁卡因胺（D错）对房性、室性心律失常均有效，但对于急性心肌梗死所致的持续性室性心律失常，其不作为首选（八版药理学P195）。